患者，女，27岁，确诊慢性乙型肝炎3年，近日化验结果：HBV-DNA2×10⁵copies/ml，ALT122U/L。拟予以抗病毒治疗，首选的药物是
A. 阿糖腺苷
B. 恩替卡韦
C. 泛昔洛韦
D. 利巴韦林
E. 膦甲酸钠

正确答案：B。恩替卡韦

解析：本题考查恩替卡韦。首选的药物是恩替卡韦（B对）。慢性乙型肝炎抗病毒治疗的适应证：①HBV-DNA≥105copies/ml；②ALT≥2倍正常上限值；③肝组织学显示Knodell HAI≥4，或≥G2炎症坏死。具有①并有②或③的患者应接受抗病毒治疗，治疗上推荐首选安全性好、耐药屏障高的药物，如替诺福韦和恩替卡韦。阿糖腺苷（A错）用于单纯疱疹性角膜炎、角膜结膜炎、脑炎，免疫抑制患者的带状疱疹和水痘感染。泛昔洛韦（C错）为抗病毒药，用于带状疱疹和原发性生殖器疱疹。利巴韦林（D错）用于呼吸道合胞病毒引起的病毒性肺炎与支气管炎，皮肤疱疹病毒感染等。膦甲酸钠（E错）用于艾滋病（AIDS）患者巨细胞病毒性视网膜炎，免疫功能损害患者耐阿昔洛韦单纯疱疹病毒性皮肤黏膜感染，用于治疗阿昔洛韦无效的单纯疱疹病毒性角膜炎，用于免疫功能损害患者对阿昔洛韦耐药的单纯疱疹病毒性皮肤、黏膜感染。